心理评估常用方法不包括
A. 调查法
B. 投射法
C. 观察法
D. 作品分析法
E. 会谈法

正确答案：B。投射法